儿童用药剂量的根据有
A. 儿童的年龄
B. 儿童的体重
C. 儿童的身高
D. 儿童的体表面积
E. 按成人剂量折算

正确答案：A、B、D、E。儿童的年龄；儿童的体重；儿童的体表面积；按成人剂量折算

解析：本题考查儿童用药的剂量计算方法。儿童剂量的计算方法一般可根据年龄（A对）、体重（B对）、体表面积（D对）及成年人剂量（E对）换算。儿童的身高（C错）一般不作为用药剂量的根据。